要调查某地人群HBsAg流行率，可采用
A. 个案调查
B. 前瞻性调查
C. 回顾性调查
D. 暴发调查
E. 抽样调查

正确答案：E。抽样调查

解析：本题考查某地人群HBsAg流行率的调查方法。要调查某地人群HBsAg流行率，可采用抽样调查（E对ABCD错）。抽样调查是一种非全面调查，它是从全部调查研究对象中，抽选一部分单位进行调查，并据以对全部调查研究对象做出估计和推断的一种调查方法。